处方直接写药名，需调配蜜炙品的是
A. 紫苏子
B. 吴茱萸
C. 枇杷叶
D. 延胡索
E. 何首乌

正确答案：C。枇杷叶